防龋工作的重点应放在哪类人群上
A. 幼儿园儿童和小学生
B. 小学生和中学生
C. 初中生和高中生
D. 所有在校中小学生
E. 高中生和大学生

正确答案：A。幼儿园儿童和小学生